生物富集作用是指
A. 生物将环境中不断摄取的低浓度的化学物质，在体内逐渐聚集，达到高浓度的能力
B. 某些污染物进入生物体内浓缩，在生物体内含量增加
C. 污染物在生物体作用下发生转化
D. 生物体内污染物含量随时间加长，含量增多
E. 以上都不是

正确答案：A。生物将环境中不断摄取的低浓度的化学物质，在体内逐渐聚集，达到高浓度的能力

解析：本题考查生物富集作用。生物富集作用是指生物将环境中不断摄取的低浓度的化学物质，在体内逐渐聚集，达到高浓度的能力（A对BCDE错）。